天竺黄的功效是
A. 燥湿化痰
B. 清热化痰
C. 敛肺止咳
D. 温肺化痰
E. 润肺化痰

正确答案：B。清热化痰

解析：本题考查的是天竺黄的功效。天竺黄功效是清热化痰（B对）。天竺黄：【功效】清热化痰，清心定惊。半夏：【功效】燥湿化痰（A错），降逆止呕，消痞散结。罂粟壳：【性能特点】本品酸涩收敛，平而偏温，有毒力强，既入肺、肾经，又入大肠经。善敛肺而止咳（C错），能涩肠而止泻，且止痛力强，为治痛证要药。然有毒易成瘾，故内服宜谨慎。【功效】敛肺，涩肠，止痛。芥子：【功效】温肺祛痰（D错），利气散结，通络止痛。瓜蒌：【功效】清肺润燥化痰（E错），利气宽胸，消肿散结，润肠通便。